女性进入青春期最早的征象为
A. 月经初潮
B. 乳房萌出
C. 身高生长突增
D. 出现腋毛
E. 出现阴毛

正确答案：C。身高生长突增

解析：本题考查青春期的分期特点。女性在青春期前身高生长突增（C对），发生在第二性征出现之前；第二性征包括声调变高，乳房丰满而隆起（B错），腋毛（D错）、阴毛（E错）出现，骨盆进一步宽大，皮下脂肪增多，月经开始来潮（A错）等。